与普通桩冠相比，桩核冠的优点为
A. 固位力强
B. 做固定桥固位体时易形成共同就位道
C. 制作方便
D. 可用于咬合紧时
E. 强度好

正确答案：B。做固定桥固位体时易形成共同就位道

解析：本题考查桩核冠与普通桩冠的区别。与普通桩冠相比，桩核冠的优点为做固定桥固位体时易形成共同就位道（B对）。桩核冠相对于普通桩冠的优点为：如人造冠需要重做，可以换冠而不用换桩核；牙的轻度错位可通过改变核的方向的办法使冠恢复到正常位置，以形成共同就位道。桩核与冠是分别完成的，可将不能做全冠大面积牙体缺损的以全冠形式进行修复。普通桩冠的固位力和桩核冠的固位力没有明显差异（A错）。普通桩冠由于通常为一体式，制作较方便（C错）。桩冠与桩核冠都可用于咬合紧的情况（D错），可选择金属冠。桩冠和桩核冠的强度均可，无明显差异（E错）。